关于药物变态反应的论述，错误的是
A. 药物变态反应与人自身的过敏体质密切相关
B. 药物变态反应绝大多数为后天获得
C. 结构类似的药物会发生交叉变态反应
D. 药物变态反应大多发生于首次接触药物时
E. 药物变态反应只发生在人群中的少数人

正确答案：D。药物变态反应大多发生于首次接触药物时